患者，男，56岁。患咳嗽气喘四五年，时轻时重，近一月以来，出现晚上低热，自觉手足心发热，心烦急躁，小便黄，应选用的与知母配伍的药物是
A. 石膏
B. 生地黄
C. 天花粉
D. 黄柏
E. 玄参

正确答案：D。黄柏

解析：知母性味苦甘寒，归肺胃肾经，功效清热泻火，滋阴润燥，治肾阴亏虚，阴虚火旺之骨蒸潮热、遗精、盗汗，常与黄柏、地黄等泻火、滋阴药同用，如知柏地黄丸（D对）。知母治温热病邪在气分之壮热、烦渴、汗出、脉洪大者，常与石膏相须为用，如白虎汤（《伤寒论》）（A错）。知母能滋阴润燥以通便，用治阴虚肠燥便秘，常与生地黄、玄参、麦冬等滋阴润肠通便药配伍（BE错）。知母苦甘寒质润，取其清热泻火、滋阴润燥、生津止渴之功，常用治内热津伤，口渴引饮之消渴证，可与天花粉、葛根等同用，如玉液汤（《医学衷中参西录》）（C错）。